男，45岁，经有经验的医生治疗后，右上6颊侧根分叉处仍探诊出血。影响根分叉病变治疗预后的原因，除外
A. 根分叉入口过小
B. 釉突
C. 患者未用牙线
D. 去除菌斑牙石不彻底
E. 多数磨牙根分叉距釉牙骨质界较近

正确答案：C。患者未用牙线

解析：本题考查影响根分叉病变预后的主要因素。男，45岁，经有经验的医生治疗后，右上6颊侧根分叉处仍探诊出血。影响根分叉病变治疗预后的原因，除外患者未用牙线（C错，为本题的正确答案）。患者未用牙线主要是导致患者牙齿邻面清洁不佳，不会影响到根分叉处的自我菌斑控制，进行根分叉处的自我菌斑控制主要采用特定形态的牙间隙刷。影响根分叉病变预后的主要因素有：1.菌斑微生物；2.牙根的解剖形态：根柱的长度、根分叉开口处的宽度及分叉角度、根面的外形；3.咬合创伤；4.牙颈部的釉质突起；5.副根管。根据病例描述，患者经有经验的医生治疗后，右上6颊侧根分叉处仍探诊出血，表明根分叉处炎症未得到控制，去除菌斑牙石不彻底（C对），使得预后欠佳。根分叉入口过小（A对）、釉突（B对）和多数磨牙根分叉距釉牙骨质界较近（E对）即根柱长度过短，都属于牙根的解剖因素，其解剖特点使得该处菌斑牙石不易清洁，使预后欠佳。